按一级动力学消除的药物特点为
A. 药物的半衰期与剂量有关
B. 为绝大多数药物的消除方式
C. 单位时间内实际消除的药量不变
D. 单位时间内实际消除的药量递增
E. 体内药物经2～3个t1/2后，可基本清除干净

正确答案：B。为绝大多数药物的消除方式

解析：本题考查药物消除动力学类型。按一级动力学消除的药物特点为为绝大多数药物的消除方式（B对）。一级消除动力学是体内药物按恒定比例消除，在单位时间内的消除量与血浆药物浓度成正比，故单位时间内实际消除的药量递减（CD错），为绝大多数药物的消除方式。按一级动力学消除的药物t1/2为一个常数，不受药物初始浓度和给药剂量（A错）的影响。按一级动力学消除的药物经过一个t1/2后，消除50％，经过两个t1/2后，消除75％，经过5个体内药物消除约97％，也就是说约经5个t1/2，药物可从体内基本消除（E错）。